血浆缓冲系统中最重要的是
A. 血浆HCO₃⁻/H₂CO₃缓冲系统
B. 红细胞Hb⁻/HHb和HbO₂⁻/HHbO₂缓冲系统
C. 血浆HPO₄²⁻/H₂PO₄⁻缓冲系统
D. 血浆Pr⁻/HPr缓冲系统
E. 其他缓冲系统

正确答案：A。血浆HCO₃⁻/H₂CO₃缓冲系统

解析：血浆缓冲系统中最重要的是血浆HCO₃⁻/ H₂CO₃缓冲系统（A对），该系统可以缓冲所有的固定酸，但是不能缓冲挥发酸。